吐弄舌者可见于
A. 血虚生风
B. 阴虚动风
C. 风痰阻络
D. 痰瘀阻滞经络
E. 小儿智能不全

正确答案：E。小儿智能不全

解析：舌伸于口外，不即回缩者，称为吐舌；舌微露出口，立即收回，或舌舐口唇四周，掉动不停者，称为弄舌；吐弄舌多主心脾有热；吐舌可见于疫毒攻心，或正气已决；弄舌多见于热甚动风先兆；吐弄舌亦可见于小儿智力发育不全（E对）。久病舌淡白而颤动者，多属血虚动风（A错）。舌红少津而颤动者，多属阴虚动风、肝阳化风（B错）。舌体强硬、胖大兼见厚腻苔者，多因风痰阻络所致（C错）。歪斜舌多因肝风内动，夹痰或夹瘀，痰瘀阻滞经络，使一侧舌肌弛缓，伸缩无力，导致伸舌时舌体向此侧偏斜（D错）。